急性化脓性腮腺炎
A. 末梢导管呈点状、球状扩张，排空迟缓，主导管及腺内导管无明显异常
B. 主导管、叶间、小叶间导管部分狭窄、部分扩张，呈腊肠样改变
C. 末梢唾液腺导管扩张，排空功能减退
D. 圆形、卵圆形或梭形充盈缺损
E. 不宜做腮腺造影

正确答案：E。不宜做腮腺造影

解析：急性化脓性腮腺炎不宜做腮腺造影，因造影剂可通过薄弱的导管壁，进入导管周围组织，使炎症扩散。掌握“慢性复发性腮腺炎”知识点。